L30D-55、滑石粉、PEG6000、十二烷基硫酸钠。根据处方组分分析，推测该药品的剂型是
A. 缓释片剂
B. 缓释小丸
C. 缓释颗粒
D. 缓释胶囊
E. 肠溶小丸

正确答案：D。缓释胶囊

解析：本题考查氧氟沙星缓释胶囊。该药品的剂型是缓释胶囊（D对）。该处方中有空白丸核，说明该药品的剂型是缓释胶囊。氧氟沙星缓释胶囊中氧氟沙星为主药；丸芯中枸橼酸为pH缓冲剂和渗透压调节剂；微晶纤维素和乳糖为稀释剂；包衣液处方中PEG6000为增塑剂；滑石粉为抗黏剂；Eudragit NE30D和Eudragit L30D-55为主要缓释包衣材；水为溶剂，十二烷基硫酸钠为稳定剂。